下颌神经穿出颅底处
A. 茎乳孔
B. 破裂孔
C. 眶下裂
D. 卵圆孔
E. 圆孔

正确答案：D。卵圆孔

解析：下颌神经含有一般躯体感觉及特殊内脏运动两种纤维，经卵圆孔（D对）出颅后分为数支，其运动纤维支配咀嚼肌、鼓膜张肌、腭帆张肌、下颌舌骨肌和二腹肌前腹。感觉纤维管理颖部、耳前、口裂以下的皮肤，口腔底和舌前2/3黏膜及下颌牙和牙跟的一般感觉。